治湿热下注之足膝肿痛，常以苍术配
A. 黄芩
B. 苦参
C. 黄柏
D. 淡竹叶
E. 白鲜皮

正确答案：C。黄柏

解析：本题考查的黄柏的配伍。治湿热下注之足膝肿痛，常以苍术配黄柏（C对）。黄柏：【配伍】黄柏配苍术：黄柏苦寒，功能清热燥湿，作用偏于下焦；苍术辛苦性温，功能燥湿健脾，兼祛风湿。两药相配，既清热又燥湿，且走下焦，治湿热诸证，特别是下焦湿热证有效。黄芩（A错）：【主治病证】（1）湿温，暑湿，湿热胸闷、黄疸、泻痢、淋痛、疮疹。（2）热病烦渴，肺热咳喘，少阳寒热，咽痛，目赤，火毒痈肿。（3）血热之吐血、咳血、衄血、便血、崩漏。（4）胎热之胎动不安。苦参（B错）：【主治病证】（1）湿疮，湿疹，疥癣，麻风，阴痒，带下。（2）湿热黄疸、泻痢、便血。（3）湿热淋痛，小便不利。淡竹叶（D错）【主治病证】（1）热病烦渴。（2）心火上炎并移热于小肠之口疮、尿赤。（3）水肿，热淋，湿热黄疸。白鲜皮（E错）：【主治病证】（1）湿热疮疹，疥癣瘙痒。（2）湿热黄疸，风湿热痹。